男，50岁。突发眼底出血1小时。高血压病史10年。规律服用降压药1年，平时血压140/95～100mmHg。查体：BP210/120mmHg，结膜无出血、充血。双肺呼吸音清，心率90次/分，律齐，双下肢无水肿。治疗宜首选
A. 口服美托洛尔
B. 静脉滴注硝普钠
C. 口服卡托普利
D. 肌肉注射利血平
E. 口服氨氯地平

正确答案：B。静脉滴注硝普钠

解析：患者中年男性，有高血压病史，平时血压140/95～100mmHg，突发眼底出血，且BP210/120mmHg（≥180/120mmHg），考虑诊断为高血压急症。高血压急症治疗宜首选静脉滴注硝普钠（B对）。硝普钠为动、静脉扩张剂，起效快，可迅速降低血压，适用于各种高血压急症。肌肉注射利血平（D错）的降压作用起效缓慢，如果短时间内反复注射可导致难以预测的蓄积效应，发生严重低血压，引起明显嗜睡反应，干扰对神智的判断（P258）。美托洛尔（A错）属于选择性β₁受体阻滞剂、卡托普利（C错）属于血管紧张素转换酶抑制剂、氨氯地平（E错）属于二氢吡啶类钙通道拮抗剂，都可作为高血压的常规用药，但一般不用高血压急症的治疗。